氧化锌丁香油水门汀的性能特点是
A. 是热和电的绝缘体，对牙髓无害
B. 不溶于唾液
C. 弹性模量和银汞合金相似
D. 足以承受银汞合金压力

正确答案：A。是热和电的绝缘体，对牙髓无害

解析：本题考查氧化锌丁香油水门汀的性能特点。氧化锌丁香油水门汀的性能特点有：1.是热和电的绝缘体，对牙髓无害（A对），导热系数近似于牙本质，一般只需0.25mm厚即可隔绝热对牙髓的刺激。2.较易溶于唾液（B错），该水门汀与唾液长时间接触的溶解率大于除氢氧化钙水门汀以外的所有其他水门汀。3.弹性模量表示材料抵抗弹性变形的能力也称刚度，银汞合金的弹性模量和釉质相近，氧化锌丁香油水门汀的弹性模量小，显示出一定的柔性，所以氧化锌丁香油比银汞合金的弹性模量低（C错）。4.强度较低，用它垫底不足以银汞合金压力（D错），因此用它垫底时不能过厚，其上还需垫一层磷酸锌水门汀。